患者，男，58岁，患有高胆固醇血症，长期服用辛伐他汀40mgqd，患者用药期间应定期检测的生化指标是
A. BUN
B. Hb
C. ALT
D. RBC
E. PLT

正确答案：C。ALT

解析：本题考查肝功能检查。该患者患有高胆固醇血症，长期服用辛伐他汀40mgqd，患者用药期间应定期检测的生化指标是ALT（C对）。他汀类药物具有肝毒性，ALT测定可评估肝细胞损伤程度。BUN（A错）是血清尿素氮，通过测定尿素氮，可了解肾小球的滤过功能。Hb（B错）是血红蛋白，可以反映贫血的程度。RBC（D错）是红细胞计数，是指单位体积血液中所含的红细胞的数目。PLT（E错）是血小板计数，是研究止血和凝血障碍的重要指标。